下列关于子宫脱垂临床特点的叙述，错误的是
A. 长期摩擦导致宫颈溃疡，出血
B. 继发感染，有脓性分泌物渗出
C. 有尿潴留出现
D. 可发生张力性尿失禁
E. 合并妊娠时，子宫脱垂程度加重

正确答案：E。合并妊娠时，子宫脱垂程度加重

解析：子宫脱垂的临床表现：Ⅰ度患者一般无不适。Ⅱ度以上患者常有不同程度的腰骶部疼痛或下坠感；站立过久、劳累后或腹压增加时症状明显，卧床休息后减轻。Ⅲ度常伴有排尿排便困难，或便秘，或遗尿，或有残余尿及张力性尿失禁（CD对），易并发膀胱炎；脱出的子宫即使休息后也不能自行回缩，通常需用手推送才能将其还纳至阴道内。脱出在外的子宫及阴道黏膜长期与衣裤摩擦可导致宫颈、阴道壁溃疡，甚至出血（A对）；继发感染时，有脓血分泌物渗出（B对）（E错，为本题正确答案）。